在病毒的增殖过程中，可出现的结构是
A. 中介体
B. 包涵体
C. 吞噬体
D. 线粒体
E. 异染颗粒

正确答案：B。包涵体